预防接种的目的是
A. 提高人群易感性
B. 降低人群易感性
C. 提高人群非特异免疫水平
D. 以上都不是

正确答案：B。降低人群易感性

解析：本题考查预防接种的目的。在传染病流行之前，通过预防接种提高机体免疫力，降低人群易感性（B对ACD错），从而有效地预防相应传染病。